亚急性硬化性全脑炎（SSPE）是一种由
A. 麻疹病毒引起的持续感染
B. 疱疹病毒引起的隐伏感染
C. 狂犬病毒引起的慢性感染
D. 脊髓灰质炎病毒引起的亚急性感染
E. 流行性乙型脑炎病毒引起的急性感染

正确答案：A。麻疹病毒引起的持续感染

解析：麻疹病毒引起麻疹。急性期患者为传染源，通过飞沫或鼻腔分泌物污染玩具及用具，而感染易感人群。此外，麻疹病毒还可引起亚急性硬化性全脑炎（SSPE）。掌握“正、副黏病毒”知识点。